患儿1天来暴泻不止，便稀如水，面色苍白，四肢厥冷，冷汗自出。其证候是
A. 风寒泻
B. 脾虚泻
C. 脾肾阳虚泻
D. 泄泻伤阳
E. 泄泻伤阴

正确答案：D。泄泻伤阳

解析：患儿暴泻不止，便稀如水，当属泄泻范畴，其泻下过多，脾肾衰弱，命门之火衰微，故见面色苍白，四肢厥冷，冷汗自出，故当辨证为泄泻伤阳（D对）。风寒泻见大便清稀，夹有泡沫，臭气不甚，肠鸣腹痛，或伴恶寒发热，鼻流清涕，咳嗽，舌质淡，苔薄白，脉浮紧，指纹淡红（A错）。脾虚泻见大便稀溏，色淡不臭，多于食后作泻，时轻时重，面色萎黄，形体消瘦，神疲倦怠，舌淡苔白，脉缓弱，指纹淡（B错）。脾肾阳虚泻见久泻不止，精神萎靡，睡时露睛。大便清稀，澄澈清冷，完谷不化，或见脱肛，形寒肢冷，面色晄白，舌淡苔白，脉细弱，指纹色淡（C错）。泄泻伤阴见泻下无度，质稀如水，色黄混浊，小便短少，皮肤干燥，目眶及前囟凹陷，啼哭无泪，舌绛无津（E错）。